8岁小儿重度贫血的诊断指标是
A. Hb＞120g/L
B. Hb＜120g/L
C. Hb＜90g/L
D. Hb＜60g/L
E. Hb＜30g/L

正确答案：D。Hb＜60g/L

解析：8岁小儿年龄界限在5～11岁之间，故其Hb正常值为115g/L，而重度贫血患儿的Hb含量常从正常下限至30g/L，血红蛋白含量在30～60g/L之间（D对）。